具有缓解胃肠痉挛作用的自主神经递质受体阻断剂是
A. 阿替洛尔
B. 阿托品
C. 酚妥拉明
D. 育亨宾
E. 筒箭毒碱

正确答案：B。阿托品

解析：自主神经受体包括乙酰胆碱受体（M胆碱受体即M1、M2、M3、M4、M5和N胆碱受体即NM、NN）、肾上腺素受体（即α1、α2、β1、β2、β3），能缓解胃肠痉挛的自主神经递质受体阻断剂是M受体阻断剂，即阿托品（B对）。阿替洛尔（A错）（P94）是选择性β1受体阻断剂，主要用于心律失常、高血压等的治疗。酚妥拉明（C错）（P88）是非选择性α受体阻断剂，可引起胃肠道平滑肌兴奋，出现腹痛、腹泻等不良反应。育亨宾（D错）（P90）是选择性α2受体阻断剂，其主要作用使血压升高、心率加快；主要用做实验研究中的工具药，并可用于治疗男性性功能障碍及糖尿病患者的神经病变。筒箭毒碱（E错）（P74）是N受体阻断剂、非除极化肌松药，可作为麻醉辅助药，用于胸腹手术和气管插管等，临床上已较少应用。